下列物质口服中毒后，解救时不宜洗胃的是
A. 苯巴比妥
B. 汽油
C. 阿片
D. 硝酸银
E. 砒霜

正确答案：B。汽油

解析：本题考查中毒解救。下列物质口服中毒后，解救时不宜洗胃的是汽油（B对）。挥发性烃类化合物（如汽油）口服中毒患者不宜洗胃，因胃反流后可引起类脂质性肺炎。苯巴比妥（A错）和阿片（C错）类药物中毒应用高锰酸钾溶液洗胃。硝酸银（D错）和砒霜（E错）应用生理盐水或1%～2%氯化钠溶液洗胃。